以下情形中，可以参加执业医师资格考试的是
A. 有医学专科学历，在医疗机构中工作满l年
B. 有医学专科学历，在医疗机构中试用期满2年
C. 有医学专科学历，在医疗机构中工作满2年
D. 取得执业助理医师执业证书后，具有医学专科学历，在医疗机构中工作满2年
E. 取得执业助理医师执业证书后，具有医学专科学历，在医疗机构中试用期满2年

正确答案：D。取得执业助理医师执业证书后，具有医学专科学历，在医疗机构中工作满2年

解析：执业医师资格考试条件：具有下列条件之一的，可以参加执业医师资格考试：①具有高等学校医学专业本科以上学历，在执业医师指导下，在医疗、预防、保健机构中试用期满1年的；②取得执业助理医师执业证书后，具有高等学校医学专科学历，在医疗、预防、保健机构中工作满2年；具有中等专业学校医学专业学历，在医疗、预防、保健机构中工作满5年的。掌握“执医概述及考试和注册”知识点。